属于容积性泻药的是
A. 甘油
B. 聚乙二醇4000
C. 乳果糖
D. 比沙可啶
E. 硫酸镁

正确答案：E。硫酸镁

解析：本题考查泻药。硫酸镁（E对）为容积性泻药，在肠内形成一定的渗透压，使肠内保有大量的水分，刺激肠蠕动而产生导泻作用。泻药包括容积性泻药、渗透性泻药、刺激性泻药、润滑性泻药、膨胀性泻药、肠道清洗剂及促胃肠动力药。甘油（A错）为润滑性泻药。聚乙二醇4000（B错）为膨胀性泻药。乳果糖（C错）为渗透性泻药。比沙可啶（D错）为刺激性泻药。